老年人继发性肾病综合征常见的疾病是
A. 乙肝病毒相关性肾炎
B. 狼疮性紫癜肾炎
C. 过敏性紫癜肾炎
D. 轻链沉积病
E. 糖尿病肾病

正确答案：E。糖尿病肾病

解析：糖尿病肾病好发于中老年，常见于病程10年以上的糖尿病患者。掌握“慢性肾小球肾炎、肾病综合征”知识点。